关于上焦生理功能特点的是
A. 主气的升发
B. 升已而降，若雾露之溉
C. 通行三气
D. 原气之别使
E. 以上都不是

正确答案：B。升已而降，若雾露之溉

解析：上焦指横膈以上的胸部，包括心、肺两脏，以及头面部，主要作用是心肺输布营养至全身，熏肤、充身、泽毛，若雾露之溉（B对）。主气的生发，是脾肾两脏的功能（A错）。通行诸气是三焦整体的功能（C错）。“三焦者，原气之别使也”（D错）。